女性，25岁，平时月经规则，3个月前妇科检查有小肌瘤，现停经2月余，阴道流血10天。妇科检查子宫如妊娠14周大，软，轻压痛，双侧附件区触及5cm囊性包块，壁薄活动好，无压痛。血HCG增高明显。最合适的治疗是
A. 立即清宫
B. 抗炎治疗
C. 腹腔镜
D. 宫腔镜
E. 性激素治疗

正确答案：A。立即清宫

解析：该患者为育龄期女性，平时月经规则，现停经2月余（疑为早孕），阴道流血10天（葡萄胎患者停经8～12周左右开始不规则阴道流血，量多少不定），妇检：子宫如妊娠14周大，软（因葡萄胎迅速增长及宫腔内出血，约半数以上患者的子宫大于停经月份，质地变软），轻压痛，双侧附件区触及5cm囊性包块，壁薄（大量hCG刺激卵巢卵泡内膜细胞发生黄素化形成卵巢黄素化囊肿。常为双侧，活动度好…囊壁薄），活动好，无压痛。血hCG增高明显（葡萄胎患者hCG水平异常升高），最可能的诊断是葡萄胎。葡萄胎诊断一经成立，应立即清宫（A对）。抗炎治疗（B错）为常规治疗，用于清宫后的预防感染。腹腔镜（第2版实用妇产科学P730）（C错）用于滋养细胞肿瘤的治疗，可在直视下抽吸黄素囊肿囊内液，减少病人肿瘤胀痛、防止发生扭转、促使血清hCG迅速下降；宫腔镜（P445）（D错）主要用于子宫内膜息肉、黏膜下肌瘤的切除治疗方式，两者均不用于葡萄胎的治疗。性激素治疗（E错）用于性激素缺乏或分泌不足、闭经的患者，不用于葡萄胎的治疗。